发生在经牙髓治疗后的患牙，由于残留了少量炎症根髓，进而又出现慢性牙髓炎的症状，故称为
A. 逆行性牙髓炎
B. 牙髓坏死
C. 急性牙髓炎
D. 慢性牙髓炎
E. 残髓炎

正确答案：E。残髓炎

解析：本题考查残髓炎及逆行性牙髓炎。发生在经牙髓治疗后的患牙，由于在牙髓治疗中残留了少量炎症根髓或多根牙遗漏未做处理的根管，进而在治疗后又出现慢性牙髓炎的症状，故称为残髓炎（E对）。